制备醋酸可的松滴眼液时，加入的亚硫酸氢钠是作为
A. 防腐剂
B. 矫味剂
C. 乳化剂
D. 抗氧剂
E. 助悬剂

正确答案：D。抗氧剂

解析：本题考查注射剂常用的附加剂。醋酸可的松滴眼液处方分析：醋酸可的松微晶-主药；亚硫酸氢钠-抗氧剂（D对）；吐温80-乳化剂（C错）；硝酸苯汞-防腐剂（A错）；硼酸-渗透压调节剂；羧甲基纤维素钠-助悬剂（E错）；蒸馏水-溶剂。此处方中无矫味剂（B错）。